男，38岁。突发呼吸困难伴短暂意识丧失，无咳嗽、咳痰及咳血。既往体健。查体：BP85/65mmHg，呼吸急促，口唇发绀，双肺可闻及少量哮鸣音，心率110次/分，P₂亢进。心电图示窦性心动过速，对明确诊断意义最大的检查是
A. CT肺动脉造影
B. 动脉血气分析
C. 胸部X线片
D. 血心肌坏死标记物
E. 血D-二聚体

正确答案：A。CT肺动脉造影

解析：患者青年男性，突发呼吸困难（急促）伴短暂意识丧失，肺动脉第二心音P₂亢进，BP85/65mmHg（正常值BP90～120/60～80mmHg），心率110次/分（正常60～100次/分），心电图示窦性心动过速（肺栓塞循环系统体征）。根据患者的病史、查体结果、临床表现，最可能的诊断是肺栓塞。肺栓塞的首选辅助检查是CT肺动脉造影（A对）。动脉血气分析（B错）无特异性。血D-二聚体（E错）、胸部X线片（C错）是疑诊肺栓塞的方法。